确诊结核性脑膜炎最可靠的依据为
A. OT试验阳性
B. 脑膜刺激征阳性
C. 胸部X线有原发结核病灶
D. 脑脊液糖和氯化物含量同时减低
E. 脑脊液查到结核杆菌

正确答案：E。脑脊液查到结核杆菌